潜函作业的主要职业有害因素是
A. 低气压
B. 高气压
C. 高氧分压
D. 低氧分压
E. 低空气压

正确答案：B。高气压